长期应用广谱抗菌药物导致的“二重感染”属于
A. 继发性反应
B. 毒性反应
C. 特异质反应
D. 变态反应
E. 副作用

正确答案：A。继发性反应

解析：本题考查药品不良反应的分类。长期应用广谱抗菌药物导致的“二重感染”属于继发性反应（A对）。继发反应是继发于药物治疗作用之后的不良反应，是治疗剂量下治疗作用本身带来的间接结果。例如，长期应用广谱抗生素，使敏感细菌被杀灭，而非敏感菌（如厌氧菌、真菌）大量繁殖，造成二重感染。毒性反应（B错）是指在药物剂量过大或体内积蓄过多时发生的危害机体的反应。特异质反应（C错）是指少数特异体质患者对某些药物反应异常敏感。变态反应（D错）是指机体受药物刺激所引起的异常免疫反应，引起机体生理功能障碍或组织损伤。副作用（E错）是指在药物按照正常用法用量使用时，出现的与治疗目的无关的不适反应。